关于单室模型单剂量血管外给药的错误表述是
A. c-t公式为双指数方程
B. 达峰时间与给药剂量X₀成正比
C. 曲线下面积与给药剂量X₀成正比
D. 峰浓度与给药剂量X₀成正比
E. 由残数法可求药物的吸收速度常数Kₐ

正确答案：B。达峰时间与给药剂量X₀成正比

解析：本题考查单室模型血管外给药。单室模型血管外途径给药，达峰时间公式为tmax=2.303/（Kₐ-k）lg（Kₐ/k），达峰时间由Kₐ、k决定，与剂量X₀无关（B错，为本题正确答案）；c-t公式包含两个指数因子，为双指数方程（A对）；曲线下面积AUC=FX₀/kV，与药剂量X₀成正比（C对）；峰浓度Cmax与药剂量X₀成正比（D对）；对残数浓度的方程式求对数，作图得到残数线，由该直线的斜率可求得速率常数Kₐ（E对）。